根据中医理论，“病”“证”“症”的概念不同，下列表述中属于“病”的是
A. 厌食
B. 嗳气
C. 脘痞
D. 腹胀
E. 便溏

正确答案：A。厌食

解析：本题考查的是症、证、病的概念。表述中属于“病”的是厌食（A对）。症，指疾病的外在表现，即症状。病，即疾病的简称，指有特定的致病因素、发病规律和病机演变的异常生命过程，具有特定的症状和体征。所谓“证”，是机体在疾病发展过程中某一阶段的病机概括，包括病变的部位、原因、性质以及邪正关系，能够反映出疾病发展过程中某一阶段的病机变化的本质，因而它比症状能更全面、更深刻、更准确地揭示出疾病的发展过程和本质。厌食，是指脾胃受纳运化功能失常所致的疾病，以较长时间的厌恶进食，食量减少为临床特征。西医学的厌食症可参考此内容辨证论治。（一）脾失健运证：【症状】食欲不振，厌恶进食，食而乏味，或伴胸脘痞闷（C错），嗳气（B错）泛恶，偶尔多食则脘腹饱胀（D错），大便不调，形体尚可，精神如常。舌淡红，苔薄白或薄腻，脉尚有力。【治法】调和脾胃，运脾开胃。【方剂应用】基础方剂为不换金正气散（陈皮、苍术、厚朴、草果、半夏、甘草、藿香、生姜、大枣）加减。【中成药应用】常用中成药有健儿消食口服液、复方消食茶。（二）脾胃气虚证：【症状】不思进食，食不知味，神倦多汗，大便溏薄（E错）夹不消化食物，面色少华，形体偏瘦，肢倦乏力。舌淡，苔薄白，脉缓无力。【治法】健脾益气，佐以助运。【方剂应用】基础方剂为异功散（人参、白术、茯苓、陈皮、甘草）加减。【中成药应用】常用中成药有参苓白术散、启脾丸。（三）脾胃阴虚证：【症状】不思进食，食少饮多，皮肤失润，大便偏干，小便短黄，甚或烦躁少寐，手足心热。舌红少津，苔少或花剥，脉细数。【治法】滋脾养胃，佐以助运。【方剂应用】基础方剂为养胃增液汤（石斛、乌梅、沙参、玉竹、白芍、甘草）加减。【中成药应用】常用中成药有儿宝颗粒。